下列结构中，为听觉感受器的是
A. 椭圆囊斑、球囊斑
B. 壶腹嵴
C. 螺旋器（corti器）
D. 耳蜗
E. 蜗管可在蜗顶处借蜗孔与前庭阶相通

正确答案：C。螺旋器（corti器）

解析：椭圆囊斑，球囊斑（A错）和壶腹嵴（B错）都属于位觉感受器。螺旋器（C对），又称Corti 器，是听觉感受器。耳蜗（D错）是骨迷路的组成部分。E选项与题干无关。